患者身热多汗，心胸烦闷，气逆欲呕，口干喜饮，舌红少苔，脉虚数。治疗应首选
A. 导赤散
B. 凉膈散
C. 生脉散
D. 竹叶石膏汤
E. 清暑益气汤

正确答案：D。竹叶石膏汤

解析：根据患者身热多汗，心胸烦闷可知其体内有虚热；口干喜饮，舌红少苔，脉虚数是内体津液耗伤的症状；气逆欲呕，提示胃气不和，胃气上逆则呕。治疗宜清热生津，益气和胃故选用竹叶石膏汤（D对）。导赤散（A错）的功用为清心利水养阴。主治：心经火热证。凉膈散（B错）的功用为泻火通便，清上泄下。主治：上中二焦火热证。生脉散（C错）的功用为益气生津，敛阴止汗。主治：温热、暑热伤气耗阴证；久咳肺虚，气阴两虚证。清暑益气汤（E错）的功用为清暑益气，除湿健脾。主治：平素气虚，又感暑湿。